吸入CO₂含量增加使呼吸运动加深、加快的主要机制是
A. 刺激外周化学感受器
B. 中枢化学感受器兴奋
C. 作用于呼吸肌
D. 通过肺牵张反射
E. 通过呼吸肌本体感受性反射

正确答案：B。中枢化学感受器兴奋